用于治疗妊娠妇女子痫和先兆子痫的首选药是
A. 依那普利
B. 普萘洛尔
C. 硫酸镁
D. 丙戊酸钠
E. 枸橼酸钾

正确答案：C。硫酸镁

解析：本题考查硫酸镁。硫酸镁（C对）用于低镁血症，并在妊娠期妇女控制子痫抽搐及防止再抽搐、预防重度子痫发展，为子痫、子痫前期治疗的首选药。依那普利（A错）用于原发性高血压、肾性高血压、心力衰竭。普萘洛尔（B错）用于高血压、心绞痛、室上性快速心律失常、室性心律失常等。丙戊酸钠（D错）用于各种类型的癫痫。枸橼酸钾（E错）用于治疗各种原因引起的低钾血症及预防低钾血症。